正确描述臀大肌的是
A. 属大腿肌后群
B. 收缩时使大腿后伸
C. 收缩时使大腿旋内
D. 防止躯干后仰
E. 肌束斜向内下

正确答案：B。收缩时使大腿后伸

解析：臀大肌属髋肌后群，而非大腿肌后群（A错），肌束斜向外下，而非斜向内下（E错），收缩时使大腿后伸（B对）和旋外，而非旋内（C错），下肢固定时能伸直躯干，防止躯干前倾，而非后仰（D错）。